关于输液（静脉注射用大容量注射液）的说法，错误的是
A. 静脉注射用乳剂中，90%微粒的直径应小于1μm
B. 为避免输液贮存过程中滋生微生物，输液中应添加适宜的抑菌剂
C. 渗透压应为等渗或偏高渗
D. 不溶性微粒检查结果应符合规定
E. pH值应尽可能与血液的pH值相近

正确答案：B。为避免输液贮存过程中滋生微生物，输液中应添加适宜的抑菌剂

解析：本题考查输液。输液中不得添加任何抑菌剂，并在贮存过程中质量稳定（B错，为本题正确答案）。静脉用乳状液型注射液中90%的乳滴粒径应在1μm以下（A对），不得有大于5μm的乳滴。输液的质量要求与注射剂基本上是一致的。但由于输液的注射量大，直接注入血液循环，因而质量要求更严格。无菌、无热原或细菌内毒素、不溶性微粒等项目必须符合规定（D对），pH与血液相近（E对）；渗透压应为等渗或偏高渗（C对）；不得添加任何抑菌剂，并在贮存过程中质量稳定；使用安全，不引起血液一般检测或血液常规检测的任何变化，不引起变态反应，不损害肝、肾功能。